常用的脂质体的制备方法
A. 注入法
B. 薄膜分散法
C. 超声波分散法
D. 凝聚法
E. 逆相蒸发法

正确答案：A、B、C、E。注入法；薄膜分散法；超声波分散法；逆相蒸发法